某男，12岁。外感风寒，内伤食积，症见恶寒发热、头痛身楚、胸脘满闷、恶心呕吐、腹痛腹泻。宜选用的成药是
A. 正柴胡饮颗粒
B. 午时茶颗粒
C. 银翘解毒颗粒
D. 桑菊感冒片
E. 九味羌活丸

正确答案：B。午时茶颗粒

解析：本题考查的是午时茶颗粒的主治。外感风寒，内伤食积，症见恶寒发热、头痛身楚、胸脘满闷、恶心呕吐、腹痛腹泻。宜选用的成药是午时茶颗粒（B对）。午时茶颗粒：【主治】外感风寒，内伤食积证，症见恶寒发热、头痛身楚、胸脘满闷、恶心呕吐、腹痛腹泻。正柴胡饮颗粒（A错）：【主治】外感风寒所致的感冒，症见发热恶寒、无汗、头痛、鼻塞、喷嚏、咽痒咳嗽、四肢酸痛；流感初起、轻度上呼吸道感染见上述证候者。银翘解毒颗粒（C错）：【主治】风热感冒，症见发热、头痛、咳嗽、口干、咽喉疼痛。桑菊感冒片（D错）：【主治】风热感冒初起，头痛，咳嗽，口干，咽痛。九味羌活丸（E错）：【主治】外感风寒夹湿所致的感冒，症见恶寒、发热、无汗、头重而痛、肢体酸痛。